经卫生部门监测，某理发店毛巾细菌总数不合格，该店毛巾细菌总数可能是
A. 50CFU/25cm²
B. 100CFU/25cm²
C. 150CFU/25cm²
D. 180CFU/25cm²
E. 300CFU/25cm²

正确答案：E。300CFU/25cm²

解析：本题考查《理发店、美容店卫生标准》。《理发店、美容店卫生标准》（GB 9666-1996）规定，毛巾细菌总数不得超过200CFU/25cm²。某理发店毛巾细菌总数不合格，该店毛巾细菌总数可能是300CFU/25cm²（E对ABCD错）。